吸入性肺脓肿最常见的病原菌是
A. 肺炎链球菌
B. 葡萄球菌
C. 绿脓杆菌
D. 大肠杆菌
E. 厌氧菌

正确答案：E。厌氧菌

解析：吸入性肺脓肿是由病原体经口、鼻、咽腔吸入致病。正常情况下，吸入物经气道黏液-纤毛运载系统、咳嗽反射和肺巨噬细胞可迅速清除。但当有意识障碍如在麻醉、醉酒、药物过量、癫痫、脑血管意外时，或由于受寒、极度疲劳等诱因，全身免疫力与气道防御清除功能降低，吸入的病原菌可致病，此外，还可由于鼻窦炎、牙槽脓肿等脓性分泌物被吸入致病，病原体多为厌氧菌（E对）。葡萄球菌（B错）多为血源性肺脓肿的感染菌。肺炎链球菌（A错）常引起肺炎链球菌肺炎。绿脓杆菌（C错）是继发性肺脓肿的常见致病菌。大肠杆菌（D错）是肠道的正常菌群，是机会性致病菌，其常导致肠外感染，以泌尿系统感染为主，较少导致呼吸系统感染。